有关滴丸剂、小丸的错误表述是
A. 滴丸剂的水溶性基质有聚乙二醇6000、泊洛沙姆
B. 滴丸的脂溶性基质有硬脂酸、单硬脂酸甘油酯
C. 滴丸剂的冷凝液有液体石蜡、甲基硅油
D. 灰黄毒素滴丸采用了固体分散技术，其目的是为了获得缓释效果
E. 小丸的粒径应为0.5～3.5mm

正确答案：D。灰黄毒素滴丸采用了固体分散技术，其目的是为了获得缓释效果

解析：本题考查滴丸剂。固体分散技术制备的滴丸具有吸收迅速、生物利用度高的特点，其目的不是获得缓释效果（D错，为本题正确答案）。滴丸剂常用基质分为水溶性基质和脂溶性基质，水溶性基质包括聚乙二醇6000、泊洛沙姆（A对）等；脂溶性基质包括硬脂酸、单硬脂酸甘油酯（B对）等；滴丸水溶性基质常用的冷凝液有液体石蜡、甲基硅油（C对）等；脂溶性基质常用的冷凝液有水或不同浓度的乙醇溶液；小丸的粒径应为0.5～3.5mm（E对）。